免疫球蛋白分类的主要依据是
A. L链
B. H链
C. 二硫键数目
D. 单体数
E. 分子量大小

正确答案：B。H链

解析：免疫球蛋白是介导体液免疫的重要效应分子，是B细胞接受抗原刺激后增值分化为浆细胞所产生的糖蛋白，主要有IgM、IgG、IgA、IgD和IgE。它们的轻链恒定区长度基本一致（A错），但不同类型的免疫球蛋白其重链恒定区的氨基酸组成和排列顺序不尽相同，因此，重链（B对）恒定区的长度决定免疫球蛋白的类别。二硫键数目（C错）、单体数（D错）和分子量大小（E错）均不是免疫球蛋白分类的主要依据。